流行性脑脊髓膜炎的典型表现是
A. 发热、皮疹、视物模糊
B. 头痛、呕吐、皮疹、昏睡
C. 发热、头痛、呕吐、腹泻
D. 发热、抽搐、呕吐、昏迷
E. 发热、头痛、皮疹、呕吐

正确答案：E。发热、头痛、皮疹、呕吐

解析：流行性脑脊髓膜炎是由脑膜炎奈瑟菌引起的急性化脓性脑膜炎。其主要临床表现是突发高热、剧烈头痛、频繁呕吐，皮肤黏膜淤点、淤斑及脑膜刺激征，严重者可有败血症休克和脑实质损害，常可危及生命。部分患者暴发起病，可迅速致死（E对）。